高血压患者，男性65岁，上颌右67残根，无心脏病史，需拔牙。为了避免意外情况发生，可采用下列措施，除了
A. 做好术前思想工作
B. 术前一小时口服镇静药
C. 术前一周停用降压药
D. 给予心电监护
E. 尽量消除紧张情绪

正确答案：C。术前一周停用降压药

解析：本题考查系统疾病对牙拔除术的影响及拔牙禁忌证-高血压。拔牙前应做好准备工作，术前可给予心痛定、安定类药物控制较高血压，减小血压波动（C错，为本题的正确答案）；术前做好思想工作（A对），消除患者紧张情绪（E对）；术前可给予适量镇静剂（B对），最好在监护下进行牙拔除术（D对）。